皮肤病损常见于腋窝、脐部和肛门周围等皱褶部位，仍为大疱，尼氏征阳性，但是在唇部有增殖表现的天疱疮类型为
A. 落叶型天疱疮
B. 寻常型天疱疮
C. 颗粒型天疱疮
D. 红斑型天疱疮
E. 增殖型天疱疮

正确答案：E。增殖型天疱疮

解析：本题考查天疱疮的分型。增殖型天疱疮（E对）皮肤病损常见于腋窝、脐部和肛门周围等皱褶部位，仍为大疱，尼氏征阳性，但是在唇部有增殖表现，皮损最初为薄壁水疱，疱破后疱底糜烂面上有肉芽组织增殖呈乳头状并伴有角化性表现。寻常型天疱疮（B错）多累及中年人，水疱疱壁薄而透明，易破溃，口腔中难以见到明显的水疱，多表现为水疱破后遗留的不规则的糜烂面，新鲜的糜烂面形状不规则，边界清晰，表面干净假膜少，周围黏膜无炎症反应，糜烂面难以愈合，陈旧性的糜烂面表面可有黄白色假膜覆盖。颗粒型天疱疮（C错）不属于天疱疮的分型，天疱疮目前倾向分为三型，不包括颗粒型。落叶型天疱疮（A错）口腔黏膜损害少见，好发于头面部和胸背部上部，水疱常发生于红斑基础上，尼氏征阳性，疱壁更薄更易破裂，在表浅糜烂面上覆有黄褐色、油腻性痂和鳞屑，如落叶状。红斑型天疱疮（D错）口腔黏膜损害较少见，好发于头面、躯干上部与上肢等暴露或皮脂腺丰富部位，一般不累及下肢；皮肤损害除有天疱疮常见的糜烂、水疱与结痂外，更多见红斑基础上的鳞屑性损害，伴有角化过度，面部皮损多呈蝶形分布，表现为两颧与跨越鼻梁的“蝶形”损害。